下列能够对药厂进行罚款处罚的部门是
A. 省级卫健委
B. 市级卫健委
C. 省级医学会
D. 药监局
E. 工商局

正确答案：E。工商局

解析：能够对药厂进行罚款处罚的部门是工商局（E对）。药监局可对药厂吊销《药品生产许可证》，但无权能罚款（D错）。